男，32岁。大量呕吐、腹泻、少尿1天。查体：T36.5℃，P110次/分，R24次/分，BP85/55mmHg，体重70kg，脉搏细速，双肺呼吸音清，未闻及干湿啰音，心律110次/分，心律齐，腹软，无压痛。估计液体丟失量至少是
A. 2100ml
B. 4900ml
C. 4200ml
D. 2800ml
E. 3500ml

正确答案：E。3500ml

解析：中年男性患者，大量呕吐、腹泻（短时间丧失大量体液，提示等渗性失水）、少尿1天。查体：T36.5℃（正常腋温36～37℃），P110次/分（正常60～100次/分），R24次/分（正常值12～20次/分），BP85/55mmHg（正常值90～120/60～80mmHg，提示患者已经休克），脉搏细速（休克表现）。双肺呼吸音清，未闻及干湿啰音，心律110次/分（正常60～100次/分），心律齐，腹软，无压痛。一般在短时间内丧失体液量达人体体重5%，病人就会出现脉搏细速、肢端发冷、血压不稳定等表现，因此估计液体丢失量至少5%×70Kg=3.5L（E对）。